患者女，36岁，已婚，面色萎黄，神疲乏力，气短懒言，食少便溏，月经淋漓不断，经血色淡，舌淡无苔，脉沉细无力。其病机是
A. 脾不统血
B. 脾肾阳虚
C. 气血两虚
D. 脾肺气虚
E. 肝血不足

正确答案：A。脾不统血

解析：脾不统血证是指脾气虚弱，统血失常，血溢脉外，以各种出血及脾气虚症状为主要表现的证。患者脾气亏虚，统血无权，冲任不固，则出现月经淋漓不断；气虚推动乏力，则神疲乏力，气短懒言；脾气虚弱，运化失健，则食少便溏；脾气亏虚，气血生化不足，加之月经淋漓不断，反复出血，营血愈亏，面、舌、脉失养，故面色萎黄，舌淡无苔，脉沉细无力；故其病机为脾不统血（A对）。脾肾阳虚是腰腹冷痛、久泄久痢、五更泄泻与虚寒症状共见（B错）。气血两虚表现为神疲乏力，少气懒言，自汗，面色淡白或萎黄，口唇、眼睑、爪甲颜色淡白，头晕目眩，心悸失眠，形体消瘦，肢体麻木，月经量少色淡，惩期甚或闭经，舌质淡白，脉弱或虚（C错）。脾肺气虚表现为久咳不止，气短而喘，咳声低微，咯痰清稀，食欲不振，腹胀便溏，面白无华，神疲乏力，声低懒言，或见面浮肢肿，舌淡苔白滑，脉弱（D错）。肝血不足表现为头晕目眩，视力减退，或夜盲，爪甲不荣，肢体麻木，失眠多梦，妇女月经量少、色淡，甚则闭经，面唇淡白，舌淡，脉细（E错）。